女性，25岁。无意中发现甲状腺肿块7天，近日迅速增长，伴有胀痛，甲状腺SPECT检查甲状腺右叶冷结节，应初步诊断为
A. 单纯性甲状腺肿
B. 结节性甲状腺肿
C. 甲状腺癌
D. 甲状腺腺瘤
E. 甲状腺囊腺瘤并发囊内出血

正确答案：E。甲状腺囊腺瘤并发囊内出血

解析：25岁女性患者（甲状腺腺瘤好发于40岁以下的妇女）。无意中发现甲状腺肿块7天（提示患者前期无症状），近日迅速增长，伴有胀痛（考虑血管破裂导致局部肿胀），甲状腺SPECT检查甲状腺右叶冷结节（提示局部组织分化不良、无功能或功能低下，可见于甲状腺囊肿、钙化、纤维化、腺瘤出血、甲状腺癌等），根据该患者的临床表现及时实验室检查，初步可诊断为甲状腺囊腺瘤并发囊内出血（E对）。若该患者颈部肿块存在多年，在短期内突然肿大，可考虑甲状腺癌（C错）。单纯性甲状腺肿（A错）通常存在多年，增长缓慢，SPECT检查无结节。结节性甲状腺肿（B错）亦通常存在多年，增长缓慢，SPECT检查可见甲状腺形态不规则或不完整，边缘不光滑。甲状腺腺瘤（D错）生长缓慢，一般无临床症状，且SPECT检查为热结节。